甲状腺功能亢进症患者的手术禁忌证是
A. 中度Graves
B. 胸骨后甲状腺肿伴甲亢
C. 高功能腺瘤
D. 妊娠早期重度甲亢
E. 青少年患者

正确答案：E。青少年患者

解析：青少年患者（E对）行甲状腺大部切除术后易发生永久性甲状腺功能减退，影响患者生长发育。青少年患者对抗甲状腺药物治疗反应较好，一般首选药物治疗，禁忌手术治疗。甲状腺功能亢进的手术指征为：①继发性甲亢或高功能腺瘤（C错）；②中度以上的原发性甲亢（A错）；③腺体较大，伴有压迫症状，或胸骨后甲状腺肿等类型甲亢（B错）；④抗甲状腺药物或者¹³¹I治疗后复发者或坚持长期用药困难者；⑤妊娠早、中期的甲亢病人凡具有以上指征者，应考虑手术治疗，并可以不终止妊娠。妊娠早期重度甲亢（D错）具有手术指征，需手术治疗。